慢性粒细胞性白血病的实验室检查特点是
A. 骨髄细胞内可见Auer小体
B. 中性粒细胞碱性磷酸酶积分增高
C. Ph染色体阳性
D. 糖原染色阳性
E. 非特异性酯酶染色阳性，可被NaF抑制

正确答案：C。Ph染色体阳性

解析：慢性粒细胞性白血病的实验室检查特点有：①血象：白细胞明显增高，血片中中性粒细胞显著增多；②骨髓象：增生明显至极度活跃，以粒系为主；③中性粒细胞碱性磷酸酶（NAP）活性减低或呈阴性反应（B错）；④出现Ph染色体（C对）和（或）BCR-ABL融合基因等。骨髄细胞内可见Auer小体（A错）可见于急性非淋巴细胞白血病、RAEB-t型骨髓增生异常综合征；糖原染色阳性（D错）主要见于急性淋巴细胞白血病；非特异性酯酶染色阳性，可被NaF抑制（E错）仅见于急性单核细胞白血病。